低温下影响食品卫生质量的主要因素是
A. 蛋白变性
B. 脂肪氧化
C. 微生物繁殖
D. 食品局部脱水
E. 制冷剂污染

正确答案：B。脂肪氧化